诱导免疫耐受形成的最佳时期是
A. 成年期
B. 幼年期
C. 老年期
D. 胚胎期
E. 青年期

正确答案：D。胚胎期

解析：免疫耐受是机体对抗原所呈现的一种负性应答现象，因此，机体免疫功能状态、免疫系统发育成熟程度、遗传背景等在很大程度上影响免疫耐受的形成和维持。免疫系统发育成熟程度低易诱导免疫耐受，胚胎期（D对）或新生儿期个体的免疫系统不成熟，易诱导免疫耐受。免疫功能成熟的成年个体（ABCE错）则不易致耐受，因为成熟的免疫细胞诱导耐受所需要的抗原量较未成熟细胞大30倍。